治疗尿浊，应首选
A. 二妙散
B. 八正散
C. 疏凿饮子
D. 程氏萆薢分清饮
E. 薏苡仁汤

正确答案：D。程氏萆薢分清饮

解析：尿浊分为三个证型：1、湿热下注证 ，治以清热利湿，分清泄浊，代表方为程氏萆薢分清饮（D对）；2、脾虚气陷证，治以健脾益气，升清固摄，代表方为补中益气汤；3、肾虚不固证，治以偏于肾阴虚者，宜滋阴益肾，代表方为知柏地黄丸；偏于阳虚者，宜温肾固摄，代表方为鹿茸固涩丸，本题所提供的答案中只有程氏萆薢分清饮适用于尿浊的治疗（D对）。二妙散，其功用为清热燥湿，适用于湿热下注证（A错）。八正散，其功用为清热泻火，利水通淋，适用于热淋证(B错)。疏凿饮子，其功用为泻下逐水，疏风发表的作用，可用于治疗水肿之湿热壅盛证（C错）。薏苡仁汤，其功用为健脾祛湿，发散风寒的作用，可用于治疗着痹证（E错）。